血涂片中发现有大量原始细胞提示
A. 慢性白血病
B. B类白血病反应
C. 再生障碍性贫血
D. 原发性血小板减少性紫癜
E. 急性白血病

正确答案：E。急性白血病

解析：急性粒细胞白血病表现为粒系原始细胞恶性增殖，粒细胞系过度增生，以原粒细胞为主，原始细胞≥0.30；可见白血病裂孔现象（即可见大量原始细胞和少量成熟细胞而缺乏中间过渡阶段的细胞）（E对）。慢性粒细胞白血病以白细胞显著增高为突出表现，多>50×10，甚至达500×10以上（A错）。类白血病反应外周血白细胞数明显增高，并有数量不等的幼稚细胞出现；但骨髓象变化不大，原始细胞及早期幼稚细胞增高不明显，无细胞畸形及核浆发育失衡，红细胞及巨核细胞系无明显异常（B错）。再生障碍性贫血是多种病因引起的骨髓造血功能衰竭，出现全血细胞减少的一组综合征（C错）。原发性血小板减少性紫癜髓病变未累及粒、红两系（D错）。